确定颌位关系是指
A. 恢复面部生理形态
B. 恢复面部适宜的垂直距离
C. 确定正确的颌间距离
D. 恢复髁状突的生理后位和面部下1/3高度
E. 纠正下颌习惯性前伸

正确答案：D。恢复髁状突的生理后位和面部下1/3高度

解析：本题考查颌位关系记录。确定颌位关系是指恢复髁状突的生理后位和面部下1/3高度（D对）。确定颌位关系包括上下颌在垂直和水平向位置关系，采用面弓记录上颌与颞下颌关节的关系，并将记录的上下颌及颞下颌关节的三者位置关系转移并固定到（牙合）架上，即恢复髁状突的生理后位和面部下1/3高度。恢复面部生理形态（A错），可以同过确定颌位关系实现，但不是确定何为关系的内容。确定颌位关系不仅要恢复面部适宜的垂直距离（B错），还要恢复水平方向的位置关系。颌间距离是指正中位时，上下牙槽嵴之间的距离，确定正确的颌间距离（C错）不是确定颌位关系的范畴。纠正下颌习惯性前伸（E错）属于水平向位置确定的范畴。